在继发性主动转运过程中，驱动小管液葡萄糖进入肾小管上皮细胞的直接动力是
A. 膜内外两侧的电位差
B. 钠泵活动造成的膜两侧Na⁺浓度差
C. 泵蛋白水解ATP释放的能量
D. 由同向转入细胞的物质提供能量
E. 同向转运体水解ATP释放的能量

正确答案：B。钠泵活动造成的膜两侧Na⁺浓度差

解析：有些物质主动转运所需的驱动力并不直接来自ATP的分解（CE错），而是利用原发性主动转运所形成的某些离子的浓度梯度（B对A错），在这些离子顺浓度梯度扩散的同时使其他物质逆浓度梯度和（或）电位梯度跨膜转运，这种间接利用ATP能量的主动转运过程称为继发性主动转运。显然，继发性主动转运依赖于原发性主动转运，若用药物抑制钠泵活动，相应的继发性主动转运也逐渐减弱或消失。葡萄糖在小肠黏膜上皮的吸收和在近端肾小管上皮的重吸收都是通过Na⁺-葡萄糖同向转运体实现的，与葡萄糖同向转入细胞的物质为钠离子，不能作为驱动小管液葡萄糖进入上皮细胞的直接动力（D错）。